遵医行为属于
A. 医疗行为
B. 治疗行为
C. 保护行为
D. 预防行为
E. 保健行为

正确答案：E。保健行为

解析：健康行为是指有助于个体在生理、心理和社会上保持良好状态的行为，包括基本健康行为、预警行为、保健行为、避开环境危害、戒除不良嗜好。保健行为（E对）是指正确、合理的利用卫生保健服务，以维护自身身心健康的行为，如定期的体格检查、预防接种、发现患病后及时就诊、咨询、遵从医嘱、配合治疗、积极康复等。基本健康行为是指日常生活中一系列有益于健康的基本行为，如合理营养、平衡膳食、积极锻炼、积极的休息与适量睡眠等。预警行为是指预防事故发生和事故发生后正确处置的行为。避开环境危害包括了人们生活和工作的自然环境与心理社会环境中对健康有害的各种因素。戒除不良嗜好是戒除日常生活中对健康有害的个人偏好，如吸烟、酗酒与滥用药品等。